顿咳痉咳期见呕吐、胁痛，其病机是
A. 肝火上逆
B. 肝失疏泄
C. 邪陷心肝
D. 胃气上逆
E. 邪郁化火

正确答案：A。肝火上逆

解析：由于时邪与伏痰胶结日久，除造成肺气上逆外，还常累及他脏，若肺病及肝，肝火上逆，横气犯胃，则可见呕吐、胁痛（A对）。肝失疏泄多见胁痛，亦可见呕吐，但非顿咳所累及所导致的后果（B错）。若邪陷心肝，应可见神昏，抽搐等表现（C错）。胃气上逆只可见呕吐，多无胁痛（D错）。邪郁化火不够精确，未精确至脏腑（E错）。